心理治疗的分类包括
A. 按理解分类
B. 按形式分类
C. 按患者意识范围大小分类
D. 按学派分类
E. 以上都是心理治疗的分类

正确答案：E。以上都是心理治疗的分类

解析：心理治疗的分类有：按理解分类：广义的心理治疗、狭义的心理治疗；按形式分：个别心理治疗、集体心理治疗；按患者意识范围的大小分：觉醒治疗、催眠治疗；按学派的理论分：心理动力学、行为主义学、人本主义学。掌握“心理治疗概述”知识点。